对淋球菌有高度抗菌活性的是
A. 大观霉素
B. 庆大霉素
C. 氯霉素
D. 土霉素
E. 米诺环素

正确答案：A。大观霉素

解析：本题考查大观霉素。大观霉素（A对）主要对淋病奈瑟菌有高度抗菌活性。庆大霉素（B错）对多种需氧的革兰阴性杆菌抗菌作用强。氯霉素（C错）对伤寒沙门菌活性强。土霉素（D错）和米诺环素（E错）属于四环素类，抗菌谱广，对阳性菌的抑制作用强于阴性菌。